对β-内酰胺酶有抑制作用的药物是
A. 替莫西林
B. 头孢美唑
C. 亚胺培南
D. 克拉维酸钾
E. 舒巴坦钠

正确答案：D、E。克拉维酸钾；舒巴坦钠

解析：本题考查β-内酰胺类抗菌药物。对β-内酰胺酶有抑制作用的药物是克拉维酸（D对）、舒巴坦（E对）。亚胺培南对β-内酰胺酶高度稳定。克拉维酸为氧青霉烷类药物，不可逆性竞争型β-内酰胺酶抑制剂。舒巴坦为青霉烷砜类药物，为不可逆竞争性β-内酰胺酶抑制剂。替莫西林（A错）为青霉素类抗菌药，头孢美唑（B错）为头孢类抗菌药，均对β-内酰胺酶无抑制作用。